伦理学的基本类型不包括
A. 规范伦理学
B. 元伦理学
C. 美德伦理学
D. 行为伦理学
E. 描述伦理学

正确答案：D。行为伦理学

解析：伦理学的类型包括：规范伦理学、元伦理学、描述伦理学、美德伦理学。元伦理学又称分析伦理学。D项为干扰选项。掌握“伦理学”知识点。